对病原携带者采取的防疫措施有
A. 早发现、早诊断、早报告、早隔离、早治疗
B. 在指定场所进行医学观察、隔离、治疗和送检病原学标本
C. 收留在指定场所进行观察，限制活动，进行诊断治疗
D. 在饮食、服务、托幼机构工作的病原携带者永久调离工作岗位
E. 艾滋病、乙型肝炎和疟疾的病原携带者严禁做献血员

正确答案：E。艾滋病、乙型肝炎和疟疾的病原携带者严禁做献血员

解析：本题考查对病原携带者采取的防疫措施。病原携带者是指感染病原体无临床症状但能排出病原体的人，包括带菌者、带毒者和带虫者。对甲类传染病及甲类管理的乙类传染病的病原携带者予以隔离治疗。有些传染病病原携带者的职业和行为受到一定的限制。如艾滋病、乙型肝炎和疟疾的病原携带者严禁做献血员（E对ABCD错）。